患者，女，35岁。面颊部外伤伴昏迷，现场紧急处理后准备护送到医院就诊，下列措施中，错误的是
A. 运送患者应俯卧位
B. 运送患者时防止窒息和休克发生
C. 额部垫高
D. 疑有颈椎损伤的患者时，应多人同时搬运
E. 运送患者应仰卧位

正确答案：E。运送患者应仰卧位

解析：运送患者时应注意保持呼吸道通畅。昏迷患者可采用俯卧位，额部垫高，使口鼻悬空，有利于唾液外流和防止舌后坠。一般患者可采取侧卧位或头侧向一侧，避免血凝块及分泌物堆积在口咽部。运送途中，应随时观察伤情变化，防止窒息和休克发生。搬运疑有颈椎损伤的患者时，应多人同时搬运，一人稳定头部并加以牵引，其他人则以协调的力量将患者平直整体移动，抬到担架上，颈部应放置小枕，头部两侧加以固定，防止头的摆动。掌握“口腔颌面部创伤急救”知识点。